主要来源于酒的脱臭除杂工艺的是
A. 甲醇
B. 甲醛
C. 铅
D. 锰
E. 氢氰酸

正确答案：D。锰

解析：本题考查主要来源于酒的脱臭除杂工艺的物质。针对发生铁混浊的酒以及采用非粮食原料（薯干、薯渣、糖蜜、椰枣等）制酒时产生的不良气味，常使用高锰酸钾-活性炭进行脱臭除杂处理。若使用方法不当或不经过复蒸馏，可使酒中残留较高的锰（D对ABCE错）。